燃烧时易熔融成红紫色液体，火焰为蓝色，产生黄白色烟，并伴有强烈蒜臭气的药材是
A. 自然铜
B. 雄黄
C. 朱砂
D. 赭石
E. 血竭

正确答案：B。雄黄

解析：本题考查的是雄黄的性状鉴别。燃烧时易熔融成红紫色液体，火焰为蓝色，产生黄白色烟，并伴有强烈蒜臭气的药材是雄黄（B对）。雄黄【性状鉴别】呈块状或粒状集合体。全体呈深红色或橙红色。块状者表面常覆有橙黄色粉末，以手触之易被染成橙黄色。晶面具金刚光泽，质脆，易碎，断面具树脂光泽。条痕橙黄色。微有特异臭气，味淡，燃之易熔融成红紫色液体，并产生黄白色烟，有强烈蒜臭气。自然铜（A错）【性状鉴别】多呈方块形，直径0.2～2.5cm。表面亮淡黄色，有金属光泽，有的表面显黄棕色或棕褐色（系氧化物，即氧化铁所致)，无金属光泽，具棕黑色或墨绿色细条纹及砂眼。立方体相邻晶面上条纹相互垂直，是其重要特征。条痕绿黑色或棕红色。朱砂（C错）【性状鉴别】为粒状或块状集合体，呈大小不一的块片状、颗粒状或粉末状。鲜红色或暗红色，有光泽。体重，质脆，条痕红色至褐红色。气微，味淡。其中呈细小颗粒或粉末状，色红明亮，触之不染手者，习称“朱宝砂”；呈不规则板片状、斜方形或长条形，大小厚薄不一，边缘不整齐，色红而鲜艳，光亮如镜面微透明，质较脆者，习称“镜面砂”；呈粒状，方圆形或多角形，色暗红或呈灰褐色，质坚，不易碎者，习称“豆瓣砂”。赭石（D错）【性状鉴别】多呈不规则扁平块状，大小不一。全体暗棕红色或灰黑色，条痕樱红色或红棕色，有的具金属光泽。一面有圆形突起，习称“钉头”，另一面与突起的相对应处有同样大小的凹窝。体重，质硬，砸碎后断面显层叠状，且每层均依“钉头”而呈波浪状弯曲，用手抚摸，则有红棕色粉末黏手，在石头上摩擦呈樱桃红色。气微，味淡。血竭（E错）【性状鉴别】呈四方形或不定形块状，大小不等，表面铁黑色或红色，常附有因摩擦而成的红粉。断面有光泽或粗糙而无光泽，黑红色，研成粉末血红色。